在选择对象时方法不当主要产生
A. 选择偏倚
B. 回忆偏倚
C. 测量偏倚
D. 失访偏倚
E. 随意误差

正确答案：A。选择偏倚

解析：本题考查选择偏倚。在选择对象时方法不当主要产生选择偏倚（A对BCDE错）。选择偏倚是由于研究对象的选择不当，如缺乏代表性（暴露组不能代表暴露人群，对照组不能代表非暴露人群）和暴露组与对照组没有可比性等，而导致的研究结果偏离真实的情况。